属于泡腾崩解剂的是
A. 硬脂酸镁
B. 依地酸二钠
C. 微晶纤维素
D. 羧甲基纤维素钠
E. 碳酸氢钠

正确答案：E。碳酸氢钠

解析：本题考查片剂的附加剂。崩解剂系指促使片剂在胃肠液中迅速破裂成细小颗粒的辅料，碳酸氢钠（E对）可做泡腾崩解剂。